初孕妇，30岁。妊娠38周，因胸闷、憋气、不能平卧3日后入院。检查：血压120/80mmHg，脉搏110次/min，呼吸22次/min。心尖部闻及3/6级收缩期杂音。半卧位时颈静脉轻度怒张，双肺底闻及湿啰音。本例产科处理的原则是
A. 立即剖宫产
B. 卧床休息，吸氧
C. 立即缩宫素引产
D. 立即前列腺素引产
E. 积极控制心力衰竭后剖宫产

正确答案：E。积极控制心力衰竭后剖宫产